某中学的校医，每学期都会给所有在校学生检查一次视力，视力表摆放在校医室。学生采取站位检查，每次她都会提醒学生双脚脚尖与地标线齐平，地标线与视力表的距离为
A. 5m
B. 4m
C. 3m
D. 2m
E. 1m

正确答案：A。5m